根据《中国药典》，关于饮片有毒无毒与用量的说法，错误的是
A. 吴茱萸，小毒，3～6g
B. 北豆根，小毒，3～9g
C. 山豆根，有毒，3～6g
D. 白果，有毒，5～10g
E. 水蛭，小毒，1～3g

正确答案：A。吴茱萸，小毒，3～6g

解析：本题考查现行《中国药典》收载毒性药材和饮片的用法用量。根据《中国药典》，关于饮片有毒无毒与用量的说法，错误的是吴茱萸，小毒，3～6g（A错，为本题正确答案）。吴茱萸，小毒，2～5g，外用适量。北豆根，小毒，3～9g（B对）。山豆根，有毒，3～6g（C对）。白果，有毒，5～10g（D对），生食有毒。水蛭，小毒，1～3g（E对），妊娠禁用。